注射剂处方中，氯化钠的作用是
A. 渗透压调节剂
B. 增溶剂
C. 抑菌剂
D. 抗氧剂
E. 止痛剂

正确答案：A。渗透压调节剂

解析：本题考查注射剂常用的附加剂。注射剂处方中常用的渗透压调节剂（A对）有：氯化钠、葡萄糖、甘油。注射剂处方中常用的增溶剂（B错）、润湿剂、乳化剂有：聚山梨酯类（吐温类）、泊洛沙姆（普朗尼克）、卵磷脂等；常用的抑菌剂（C错）有苯酚、甲酚尼泊金类等；常用的抗氧剂（D错）有：亚硫酸（氢）钠、焦亚硫酸钠、硫代硫酸钠；常用的止痛剂（E错）（局麻剂）有盐酸普鲁卡因、利多卡因等。